从后退接触位到最大前伸位的距离是
A. 10mm
B. 12mm
C. 8mm
D. 14mm
E. 13mm

正确答案：A。10mm

解析：本题考查从后退接触位到最大前伸位的距离。从后退接触位到最大前伸位的距离是10mm（A对）。后退接触位是从牙尖交错位开始，下颌向后少许移动至最后位；最大前伸位指下颌前伸至最大前伸位并保持咬合接触时的颌位，此时只有后牙接触，前牙不接触。